中毒表现为胸闷、心悸、心律不齐，心电图显示房室传导阻滞，是因
A. 服用了含轻粉的中成药
B. 服用了含马钱子的中成药
C. 服用了含蟾酥的中成药
D. 服用了含马兜铃酸成分的中成药
E. 服用了含天南星的中成药

正确答案：C。服用了含蟾酥的中成药

解析：本题考查的是蟾酥及含蟾酥的中成药的中毒表现。中毒表现为胸闷、心悸、心律不齐，心电图显示房室传导阻滞，是因服用了含蟾酥的中成药（C对）。服用蟾酥及含蟾酥的中成药的中毒表现：1.循环系统：表现为胸闷、心律失常、脉缓慢无力、心电图显示房室传导阻滞等。严重时面色苍白、口唇发绀、四肢厥冷、大汗虚脱、血压下降、休克，甚至心搏骤停而死亡。2.消化系统：表现为恶心呕吐、腹痛、腹泻等。服用含朱砂、轻粉、红粉的中成药（A错）的中毒表现：1.消化系统表现为恶心呕吐、腹痛腹泻、口中有金属味、流涎、口腔黏膜充血、牙龈肿胀溃烂等。2.泌尿系统表现为少尿、蛋白尿，严重者可发生急性肾功能衰竭。3.神经系统及精神方面症状。服用马钱子及含马钱子的中成药（B错）的中毒表现：初期出现头晕、头痛、烦躁不安、面部肌肉紧张、吞咽困难；进而伸肌与屈肌同时做极度收缩，发生典型的士的宁惊厥、痉挛，甚至角弓反张，可因呼吸肌痉挛窒息或心力衰竭而死亡。服用含马兜铃酸成分的中成药（D错）可导致严重的肾损害。含马兜铃酸类对肾功能的影响：马兜铃、天仙藤、寻骨风等均含马兜铃酸，中毒可致肾小管坏死出现面部浮肿，渐至全身水肿、尿频尿急，甚至出现急、慢性肾功能衰竭及尿毒症而死亡。服用含天南星成分的中成药（E错）的中毒表现，2022年考试指南未明确说明。